朱砂安神丸的主治是
A. 阴虚血少所致的心神不安
B. 心气虚寒所致的心神不安
C. 心阴不足所致的心神不安
D. 情志不畅肝气郁滞所致的心神不安
E. 心火亢盛阴血不足所致的心神不安

正确答案：E。心火亢盛阴血不足所致的心神不安

解析：本题考查的是朱砂安神丸的主治。朱砂安神丸的主治是心火亢盛阴血不足所致的心神不安（E对）。朱砂安神丸：【主治】心火亢盛、阴血不足证，症见心神烦乱、失眠多梦、心悸不宁、舌尖红、脉细数。养血安神丸：【主治】阴虚血少所致的头眩心悸、失眠健忘（A错）。柏子养心丸：【主治】心气虚寒，心悸易惊，失眠多梦，健忘（B错）。天王补心丸：【主治】心阴不足，心悸健（C错）忘，失眠多梦，大便干燥。解郁安神颗粒：【主治】情志不畅、肝郁气滞所致的失眠、心烦、焦虑、健忘（D错）；神经官能症、更年期综合征见上述证候者。